根据“母补泻法”，肾经实证应取的腧穴是
A. 阴谷
B. 复溜
C. 然谷
D. 太溪
E. 涌泉

正确答案：E。涌泉

解析：《难经·六十九难》提出“虚者补其母，实者泻其子”的思想，将五输穴配属五行，然后按“生我者为母，我生者为子”的原则，虚证用母穴，实证用子穴。这一取穴法亦称子母补泻取穴法。在具体运用时，分本经子母补泻和他经子母补泻两种方法。按照本经子母补泻法，肾经的虚证应“泻其子”，肾为“水”，“水”生“木”，“木”为“水”之子，因此，应选肾经中属“木”的五输穴，即井穴涌泉穴（E对）。